临床治疗敏感厌氧菌引起的严重感染宜选用的药物是
A. 阿奇霉素
B. 阿莫西林
C. 头孢拉定
D. 克林霉素
E. 左氧氟沙星

正确答案：D。克林霉素